休克淤血期，下列哪一种变化是错误的
A. 血管壁通透性增加，血浆外渗丢失
B. 血液粘度增大
C. 全身有效血容量不足，组织液入血代偿
D. 细胞膜泵功能障碍，组织细胞水肿
E. 毛细血管血流停滞，血液潴积于某些内脏

正确答案：C。全身有效血容量不足，组织液入血代偿

解析：休克淤血期由于毛细血管后阻力大于前阻力，血管内流体静压升高，使组织液进入毛细血管的缓慢“自身输液”停止（C错，为本题正确答案），血管壁通透性增加，有血浆渗出到组织间隙。血浆外渗（A对）导致血液浓缩，血液粘度增大（B对），红细胞聚集，毛细血管血流停滞，血液潴积于某些内脏（E对），使有效循环血量进一步减少，形成恶性循环。休克淤血期损伤细胞膜，引起细胞膜泵功能障碍，组织细胞水肿（D对）。